初孕妇，确诊为部分性前置胎盘，流血多，BP：80/50mmHg，宫口开大4.0cm，胎头棘下2cm，胎心尚好，应在输血的同时行
A. 人工破膜
B. 头皮钳
C. 胎头吸引
D. 剖宫产
E. 臀位时，牵引胎足压迫止血

正确答案：D。剖宫产

解析：因为本例流血多，血压低于正常，题中产妇已经因前置胎盘出血出现了休克表现，故考虑应尽快结束分娩过程，以缓解并针对休克进行处理。掌握“前置胎盘”知识点。